固定义齿修复的最佳时间一般是在拔牙后
A. 4周
B. 5周
C. 6周
D. 2个月
E. 3个月

正确答案：E。3个月

解析：本题考查固定桥的适应证与禁忌证。缺牙区伤口愈合，一般在拔牙后3个月（E对）内，待拔牙创口完全愈合，牙槽嵴吸收基本稳定后制作固定义齿。